颌骨内有许多大小不等、形态各异的小牙堆积，病变下方常有恒牙阻生
A. 骨化纤维瘤
B. 骨纤维异样增殖症
C. 成釉细胞瘤
D. 牙源性角化囊性瘤
E. 组合性牙瘤

正确答案：E。组合性牙瘤

解析：组合性牙瘤表现为颌骨内有许多大小不等、形态各异的小牙堆积，病变下方常有恒牙阻生。掌握“骨化纤维瘤”知识点。